膀胱癌在病理上最重要的是
A. 组织类型
B. 分化程度
C. 病变部位
D. 浸润深度
E. 生长方式

正确答案：D。浸润深度

解析：膀胱癌的病理与肿瘤的组织类型、细胞分化程度、生长方式、浸润深度有关，其中细胞分化程度和浸润深度对预后的影响最大。细胞分化程度仅能表示肿瘤的恶性程度；而浸润深度是肿瘤临床和病理分期的重要依据，故膀胱癌在病理上最重要的是浸润深度（D对B错）。组织类型（A错）、病变部位（C错）、生长方式（E错）可以作为病理分期的参考，但其参考价值不及浸润深度。